下列哪项对上前牙邻面接触点的描述是正确的
A. （牙合）龈径小于唇舌径
B. 邻面中1/3
C. 邻面切1/3
D. 邻面龈1/3
E. 以上都不是

正确答案：C。邻面切1/3

解析：本题考查上前牙邻面接触点。上前牙接触区似三角形，顶为切端，底为颈缘，所以（牙合）龈径大于唇舌径（A错）。上前牙包括上中切牙、侧切牙和尖牙，邻面接触点均在邻面切1/3（C对BD错）。